静脉注射两性霉素B的适宜溶媒是
A. 0.9%氯化钠注射液
B. 5%葡萄糖注射液
C. 50%葡萄糖注射液
D. 复方氯化钠注射液
E. 低分子右旋糖酐注射液

正确答案：B。5%葡萄糖注射液

解析：本题考查药物的适宜溶剂。静脉注射两性霉素B的适宜溶媒是5%葡萄糖注射液（B对）。两性霉素B因与氯化钠溶解和析出沉淀，因此不宜用0.9%氯化钠注射液溶解，可选用5%葡萄糖注射液溶解。